在使用注意方面，宜从小量开始，缓缓增加，以免阳升风动，头晕目赤的药物是
A. 冬虫夏草
B. 石斛
C. 鳖甲
D. 白术
E. 鹿茸

正确答案：E。鹿茸

解析：该题考查的是鹿茸的使用注意事项，属记忆内容。鹿茸的使用注意 服用本品宜从小量开始，缓缓增加，不可骤用大量，以免阳升风动，头晕目赤，或伤阴动血。凡发热者均当忌服（E对）。